兼具抗幽门螺杆菌作用的抗酸药是
A. 氢氧化铝
B. 米索前列醇
C. 西米替丁
D. 哌仑西平
E. 奥美拉唑

正确答案：E。奥美拉唑

解析：本题考查奥美拉唑。奥美拉唑（E对）（omeprazole）有强大持久的抑制胃酸分泌作用。抑制胃酸作用持久，连续服用的效果优于单次服用。由于胃内pH升高，反馈性地使血中胃泌素水平升高。但由于本药对组胺，五肽胃泌素等刺激引起的胃酸分泌亦有明显抑制作用，所以并不影响其抑制胃酸分泌作用。动物实验证明对胃黏膜损伤有预防保护作用。体外试验证明有抗幽门螺杆菌作用。临床用于治疗溃疡病。